下列氨基酸中能转化生成儿茶酚胺的是
A. 蛋氨酸
B. 脯氨酸
C. 天冬氨酸
D. 色氨酸
E. 酪氨酸

正确答案：E。酪氨酸

解析：本题考查能转化生成儿茶酚胺的氨基酸。能转化生成儿茶酚胺的氨基酸是酪氨酸（E对）。蛋氨酸（甲硫氨酸）（A错）属于含硫氨基酸，其转甲基作用与甲硫氨酸循环有关，还可为肌酸合成提供甲基。脯氨酸（B错）可在体内被修饰生成羟脯氨酸。天冬氨酸（C错）参与嘌呤和嘧啶的从头合成。色氨酸（D错）可5-羟色氨酸生成5-羟色胺，是一种抑制性神经递质。